洋地黄中毒的心电图变化最常表现为
A. 室性期前收缩
B. ST-T呈鱼钩样改变
C. Q-T间期缩短
D. 心房颤动
E. 房室传导阻滞

正确答案：A。室性期前收缩

解析：洋地黄中毒的心电图变化最常表现为室性期前收缩（A对），约占心脏毒性发生率的1/3，也可发生二联律、非阵发性交界区心动过速、心房颤动（D错）及房室传导阻滞（E错）、Q-T间期缩短（C错）、ST-T呈鱼钩样改变（B错），但并非最常见的心电图表现。